下列选项属于麦冬功效的是
A. 养阴生津，润肺清心
B. 补气养阴，健脾润肺
C. 补气养阴，润肺益肾
D. 养阴润燥，生津止渴
E. 养阴润燥，清肺生津

正确答案：A。养阴生津，润肺清心

解析：麦冬味甘、微苦，性微寒，归心、肺、胃经，具有养阴润肺，益胃生津，清心除烦的功效（A对）。甘寒养阴，能清养肺胃之阴而润燥；苦寒泄热入心，可清心除烦热而安神。滋燥补阴而不粘腻，偏于生津益肺胃。